患者，女，25岁，诊断为十二指肠溃疡，Hp（+），根除Hp四联疗法的用药疗程为
A. 8周
B. 4周
C. 6个月
D. 3个月
E. 2周

正确答案：E。2周

解析：本题考查消化性溃疡的药物治疗。根除Hp经验性铋剂四联治疗方案疗程为10日或14日。推荐的7种经验性根除治疗方案的临床试验均采用了14日疗程，根除率＞90%，因此尽可能将疗程延长至14日（E对）应该是合适的选择。